上颌第一磨牙残根完全拔除，拔牙后发现上颌窦瘘，窦底穿孔，但窦孔不大时
A. 使血凝块充填
B. 冲洗拔牙窝
C. 止血药物填塞
D. 行上颌窦瘘修补术
E. 缝合拔牙创口

正确答案：A。使血凝块充填

解析：由于上颌窦发育过大，牙根尖接近窦底，拔牙时可造成上颌窦底穿孔，小者血凝块充填，可自行愈合；大者或上颌窦原有炎症，常发生上颌窦瘘。应及时清除窦腔内残留牙根与异物，待炎症消退后，行口腔上颌窦瘘修补术。掌握“牙槽外科”知识点。